治疗小儿疳积时，宜选何经经穴为主？
A. 督脉和足阳明经
B. 足太阴和足阳明经
C. 任脉和足阳明经
D. 足太阴和手阳明经
E. 手阳明和足阳明经

正确答案：B。足太阴和足阳明经

解析：小儿疳积的病位主要在脾、胃，基本病机是脾胃受损，气血津液亏耗，故针灸治疗时应主选足太阴脾经和足阳明胃经（B对）。